从牙尖顶端斜向近、远中的嵴，称为
A. 切嵴
B. 边缘嵴
C. 牙尖嵴
D. 三角嵴
E. 斜嵴

正确答案：C。牙尖嵴

解析：牙尖嵴：从牙尖顶端斜向近、远中的嵴，称为牙尖嵴。掌握“牙的萌出、更替及牙体解剖名词、标志”知识点。